用穿刺及细胞学检查诊断的病变及其穿刺液的关系的叙述中，正确的是
A. 囊肿→穿刺液涂片检查有时有胆固醇晶体
B. 囊性淋巴管瘤→穿刺液涂片检查有时有胆固醇晶体
C. 血管瘤→淋巴液
D. 囊性淋巴管瘤→血性液体
E. 以上均正确

正确答案：A。囊肿→穿刺液涂片检查有时有胆固醇晶体

解析：穿刺及细胞学检查：对触诊时有波动感或非实质性含有液体的肿瘤，可用注射针作穿刺检查。几种常用该法诊断的病变及其穿刺液的关系：囊肿→穿刺液涂片检查有时有胆固醇晶体；血管瘤→血性液体；囊性淋巴管瘤→淋巴液。掌握“口腔颌面部肿瘤的概念、临床表现、诊断”知识点。